下列哪种物质是抗原
A. 青霉素
B. 溶血素
C. 抗毒素
D. 凝集素
E. 类毒素

正确答案：E。类毒素

解析：类毒素属于抗原。掌握“抗原基本概念、分类、超抗原及佐剂”知识点。